男，72岁。排便时突然跌倒，意识丧失，呼吸断续有陈旧心肌梗死和糖尿病病史，无高血压病史，诊断为心脏骤停。心电图示心搏停顿，此时首选的药物是
A. 普鲁卡因酰胺
B. 肾上腺素
C. 普罗帕酮
D. 胺碘酮
E. 碳酸氢钠

正确答案：B。肾上腺素

解析：心脏骤停抢救最关键的是尽早心肺复苏，而心肺复苏的首选药物是肾上腺素（B对）。肾上腺素（九版药理学P81）可作用于心肌、传导系统和窦房结的β₁和β₂受体，加强心肌收缩性，加速传导，加快心率，提高心肌的兴奋性，有助于自主心律的恢复。普鲁卡因酰胺（普鲁卡因胺）（A错）、普罗帕酮（C错）、胺碘酮（D错）为心肺复苏时常用的抗心律失常药物。碳酸氢钠（E错）主要用于治疗心脏骤停引起的严重代谢性酸中毒。